心衰的诱因是
A. 高钾血症
B. 甲状腺功能亢进
C. 两者均有
D. 两者均无
E. 无

正确答案：C。两者均有

解析：凡是能增加心脏负荷，使心肌耗氧量增加和（或）供血供氧减少的因素皆可为心功能不全的诱因。高钾血症可通过干扰心肌的正常生理特性使心脏发生心律失常，导致心脏各部分舒缩活动的协调性受到破坏，心泵血功能紊乱，心排血量降低，诱发心衰。甲状腺功能亢进时，浓度过高的甲状腺激素直接或间接作用于心脏，使心率增快、心肌收缩力增加，因而心肌耗氧增加，加重心脏负荷，久之可因失代偿导致心衰。（AB对，故C为本题正确答案）